以下除哪项外均为目前公认的导致四类主要慢性病的最重要的、共同的和可改变的危险因素
A. 吸烟（包括二手烟暴露）
B. 过量饮酒
C. 不健康的饮食习惯
D. 遗传因素
E. 少体力活动

正确答案：D。遗传因素